对于新生儿坏死性小肠结肠炎的诊断最有意义的辅助检查是
A. 腹部X线平片
B. 粪培养
C. 腹部B超
D. 粪常规
E. 血培养

正确答案：A。腹部X线平片

解析：新生儿坏死性小肠结肠炎是新生儿期常见的严重胃肠道疾病，多见于早产儿，临床以腹胀、呕吐便血为主要表现，腹部X线检查以肠壁囊样积气为特征，腹部X线平片（A对）对本病诊断有重要意义，尤其肠壁积气和门静脉充气征为本病的特征性表现。腹部超声随着近年来分辨率提高，有报道称，与腹部X线片相比，超声诊断门静脉积气、肠壁积气 的敏感性更高。故本题正确答案可以是A、C，标准答案正确选项为A。 其余选项（BDE错）对于该疾病的诊断无特异性。